关于淋病的描述，以下哪项错误
A. 宫颈充血、水肿、脓性分泌物
B. 分泌物淋球菌培养阳性率低，不可靠
C. 分泌物涂片检查，找到革兰染色阴性双球菌，可作为筛查手段
D. 作后穹窿穿刺，抽出液中可找到淋球菌
E. 淋病的治疗首选第三代头孢菌素治疗

正确答案：B。分泌物淋球菌培养阳性率低，不可靠